有关脑桥的描述中错误的是
A. 有第5~8对脑神经相连
B. 基底沟容纳基底动脉
C. 脑桥臂向后缩细移行为小脑下脚
D. 背侧为菱形窝的上份
E. 无

正确答案：C。脑桥臂向后缩细移行为小脑下脚

解析：脑桥有三叉神经、展神经、面神经和前庭蜗神经，即第5~8对脑神经相连（A对），脑桥基底沟容纳基底动脉（B对），脑桥臂（C错，为本题正确答案）即小脑中脚由基底部向外后逐渐变窄形成，脑桥背侧面形成菱形窝的上半部（D对）。